某农药厂生产工人，因马拉硫磷中毒入院，出现毒蕈碱样症状、烟碱样症状和中枢神经系统症状。治疗该种中毒病例不宜
A. 用温水或2%碳酸氢钠溶液反复洗胃
B. 轻度中毒者给予阿托品
C. 热水清洗污染的皮肤
D. 中度中毒者，阿托品及胆碱酯酶复能剂（如氯解磷定、碘解磷定）两者并用
E. 注意迟发性中毒综合征的出现

正确答案：C。热水清洗污染的皮肤